急性脑血管疾病致昏迷病人呼吸最常见的类型
A. 呼吸浅慢
B. 呼吸浅快
C. 呼吸深慢
D. 呼吸不规则
E. 呼吸深快

正确答案：C。呼吸深慢

解析：急性脑血管疾病致昏迷病人由于呼吸中枢受增高的颅内压和供血减少的刺激，使呼吸变为慢深（C对），并常伴有呼吸节律的改变。呼吸浅慢一般见于吗啡、巴比妥类药物和有机磷杀虫药中毒（A错）。呼吸浅快一般见于精神性呼吸困难，临床上一般见于焦虑症、癔症病人（B错）。呼吸不规则一般见于中枢神经系统疾病，常见如脑炎、脑膜炎等（D错）。呼吸深快一般见于急性呼吸窘迫综合征（ARDS）患者（E错）。